患者，女，30岁。突发皮疹，为红色粟粒状，每遇热或在阳光下即发，舌边尖红，苔薄白治以祛风散热止痒，宜以蝉衣薄荷等配伍的药物是
A. 苦参
B. 白僵蚕
C. 地肤子
D. 龙胆草
E. 黄连

正确答案：B。白僵蚕

解析：白僵蚕具有息风止痉，祛风止痛，化痰散结的功效；本品辛散，入肝肺经，有祛外风、散风热、止痛、止痒的功效；其治疗风疹瘙痒，可配伍蝉蜕、薄荷、防风等祛风止痒药，亦可单用研末服用（B对）。苦参既能清热燥湿，又能杀虫止痒。治疗湿疹湿疮，皮肤瘙痒，疥癣麻风，滴虫性阴道炎（A错）。地肤子能清除皮肤中之湿热与风邪而止痒。治疗阴痒带下，风疹，湿疹，皮肤瘙痒（C错）。龙胆草治疗湿热下注，带下黄臭、阴肿阴痒、湿疹瘙痒（D错）。黄连治疗痈肿疔疮，目赤肿痛，口舌生疮；湿疹湿疮，耳道流脓（E错）。